可直接抑制凝血因子Xa，并与抗凝血酶Ⅲ结合的抗凝血药是
A. 华法林
B. 依诺肝素
C. 氨甲环酸
D. 达比加群酯
E. 利伐沙班

正确答案：E。利伐沙班

解析：本题考查抗凝血药。可直接抑制凝血因子Xa，并与抗凝血酶Ⅲ结合的抗凝血药是利伐沙班（E对）。可抑制维生素K环氧化酶活动的抗凝血药是华法林（A错）。依诺肝素（B错）可能导致牙龈出血。氨甲环酸（C错）为具有抗纤维蛋白溶解作用的促凝血酶。达比加群酯（D错）属于直接凝血酶抑制剂类抗凝血药。